下列关于信访法说法不正确的是
A. 灵活性较差
B. 问卷有效率较高
C. 花费小
D. 耗时小
E. 很难保证调查样本对总体的代表性

正确答案：B。问卷有效率较高

解析：本题考查信访法的特点。信访法是由调查者将问卷邮寄给调查对象，调查对象按照要求填写问卷，再寄回给调查者的资料收集方法。信访法比较节省时间（D对）和费用（C对），但灵活性较差（A对），很难保证调查样本对总体的代表性（E对），问卷有效率较低（B错，为本题正确答案）。